基因重排是
A. 小缺失的片段倒转后仍插入原来位置
B. 小缺失的片段不倒转插入原来位置
C. 小缺失的片段倒转后插入其他位置
D. 小缺失的片段不倒转插入其他位置
E. DNA断裂和重接引起的姐妹染色单体交换

正确答案：A。小缺失的片段倒转后仍插入原来位置